RNA聚合酶在转录起始时结合的序列是
A. 密码子
B. 增强子
C. 启动子
D. 沉默子
E. 反密码子

正确答案：C。启动子

解析：聚合酶在转录起始时结合的序列是启动子（C对），启动子提供转录起始信号。密码子（A错）是mRNA链上决定一个氨基酸的相邻的三个碱基，mRNA决定蛋白质分子中的氨基酸种类和排列次序。反密码子（E错）是位于tRNA反密码环中部、可与mRNA中的三联体密码子形成碱基配对的三个相邻碱基，在蛋白质合成过程中，携带特定氨基酸的tRNA根据反密码子识别mRNA上的密码子，把携带的氨基酸加入到多肽链的一定位置上。增强子（B错）是可以增强真核基因启动子工作效率的调控序列，决定着基因在细胞内的表达水平。沉默子（D错）是负调节元件，可抑制基因转录，结合转录调节因子并抑制基因表达。